硫脲类抗甲状腺药严重的不良反应是
A. 粒细胞减少
B. 黏膜出血
C. 再生障碍性贫血
D. 血小板减少性紫癜
E. 溶血性贫血

正确答案：A。粒细胞减少

解析：硫脲类抗甲状腺药不良反应：最严重的是粒细胞缺乏症，一般发生在治疗后2～3个月内，老年人较易发生，应定期检查血象（A对）。